可作为气雾剂抛射剂的是
A. 乙醇
B. 七氟丙烷
C. 聚山梨酯
D. 维生素C
E. 液状石蜡

正确答案：B。七氟丙烷

解析：本题考查气雾剂的抛射剂。七氟丙烷（B对）可作为气雾剂的抛射剂；乙醇（A错）可作为潜溶剂；聚山梨酯（C错）可作为表面活性剂；维生素C（D错）可作为抗氧化剂；液体石蜡（E错）可作乳膏剂的油相基质。